属于选择性5-羟色胺再摄取抑制剂的是
A. 阿米替林
B. 氟西汀
C. 吗氯贝胺
D. 文拉法辛
E. 米氮平

正确答案：B。氟西汀

解析：本题考查5-羟色胺（5-HT）再摄取抑制剂。氟西汀（B对）及其代谢产物去甲氟西汀都选择性地抑制中枢神经系统对5-HT的再吸收，延长和增加5-HT的作用，为较强的抗抑郁药。阿米替林（A错）为二苯并庚二烯类的代表药，该类药属于去甲肾上腺素的再摄取抑制剂。吗氯贝胺（C错）为单胺氧化酶抑制剂类抗抑郁药，其作用是通过可逆性抑制脑内A型单胺氧化酶，从而提高脑内去甲肾上腺素、多巴胺和5-羟色胺的水平。文拉法辛（D错）为5-HT及去甲肾上腺素再摄取抑制剂代表药，该类药小剂量主要抑制5-HT的再摄取，大剂量时对5-HT和NE的再摄取均有抑制作用。米氮平（E错）是中枢突触前膜α₂受体拮抗剂，可以增强肾上腺素能的神经传导，它同时阻断中枢的5-HT₂和5-HT₃受体。